易发生超敏反应，用药前常规给予地塞米松、苯海拉明和西咪替丁加以预防的抗肿瘤药是
A. 注射用柔红霉素
B. 注射用硫酸长春新碱
C. 紫杉醇注射液
D. 注射用盐酸博来霉素
E. 注射用环磷酰胺

正确答案：C。紫杉醇注射液

解析：本题考查药物的不良反应。抗肿瘤药紫杉醇（C对）以特殊溶剂聚乙烯醇蓖麻油进行溶解，可能导致超敏反应，需要常规进行糖皮质激素、抗组胺药物和组胺H₂受体阻断剂的预处理。柔红霉素（A错）不良反应为心脏毒性。长春新碱（B错）不良反应为骨髓功能抑制。博来霉素（D错）不良反应为肺毒性。环磷酰胺（E错）不良反应为膀胱毒性。